诊断库欣综合征最有意义的检查是
A. ACTH兴奋性试验
B. 甲吡酮试验
C. 赛庚啶试验
D. 地塞米松抑制试验
E. 螺内酯试验

正确答案：D。地塞米松抑制试验

解析：库欣综合征为各种病因造成肾上腺分泌过多糖皮质激素所致病症的总称。其血浆皮质醇分泌增多，失去昼夜节律，且不能被小剂量地塞米松抑制（P700）。地塞米松为人工合成的糖皮质激素中生物作用最强的激素之一，仅需要很小的剂量即能达到与天然皮质醇相似的作用，使用小剂量地塞米松可抑制正常人的皮质醇分泌，血皮质醇测定值减少，而库欣综合征却不受影响。小剂量地塞米松抑制试验可以诊断库欣综合征，而大剂量地塞米松抑制试验可以鉴别库欣综合征的不同病因，因此诊断库欣综合征最有意义的检查为地塞米松抑制试验（D对）。ACTH兴奋试验（A错）主要用于肾上腺皮质功能减退症的诊断。甲吡酮试验（B错）为测定垂体分泌ACTH储备功能的一种方法，可以用于鉴别不同病因的库欣综合征，但其诊断意义有限。赛庚啶试验（C错）主要用于鉴别特发性醛固酮增多症和醛固酮瘤。螺内酯试验（E错）主要用于诊断原发性醛固酮增多症。